对于流行病学实验研究，下列哪种说法不正确
A. 设计和实验条件高、控制严、难度大
B. 样本量大、随访时间长、易失访
C. 花费人力、物力、财力，有时还可涉及医德问题
D. 其研究结果的科学价值还不如分析性研究方法

正确答案：D。其研究结果的科学价值还不如分析性研究方法

解析：本题考查实验流行病学的特点。实验流行病学的设计和实验条件高、控制严、难度大（A对）；实验流行病学的样本量大、随访时间长、易失访（B对）；实验流行病学花费的人力、物力、财力较多，有时还可涉及医德问题（C对）；实验流行病学中的干预措施由研究者所控制，实验现象由实验者亲自观察，研究人群又随机分组，从而对结局作解释时能够较好地排除那些外部因素的干扰作用，因此其检验因果关系假设的能力强于分析性研究（D错，为本题正确答案）。